小儿T细胞分泌INF-γ达成人水平的年龄是
A. 半岁
B. 2岁
C. 3岁
D. 4岁
E. 5岁

正确答案：A。半岁

解析：细胞因子IFN-γ于生后175天即达到成人水平（A对）。